女，79岁，1小时前家属发现其呼吸困难而来诊。查体：T36.8℃，R32次/分。BP140/90mmHg，嗜睡，球结膜水肿，皮肤潮湿，口唇发绀，双下肺可闻及细湿啰音和哮鸣音。心率120次/分，双下肢水肿。为明确诊断，进一步检查宜首选的是
A. 胸部CT
B. 心肌坏死标志物
C. 心电图
D. 头颅CT
E. 动脉血气分析

正确答案：E。动脉血气分析

解析：患者为老年女性，1小时前呼吸困难，嗜睡，球结膜水肿，皮肤潮湿，口唇发绀，双下肺可闻及细湿啰音和哮鸣音，心率120次/分，双下肢水肿，根据其临床表现和体征，考虑诊断为由缺氧和CO₂潴留所致的肺性脑病（患者有呼吸困难，缺氧的症状，且出现了神经精神障碍）。为明确诊断，需要做动脉血气分析（E对），了解患者体内PaO₂和PaCO₂等一系列指标，以明确是否存在缺氧和CO₂潴留。胸部CT（A错）用来了解胸部占位性病变，并不能了解体内PaO₂和PaCO₂等一系列指标，若患者考虑肺癌，可首选胸部CT。心肌坏死标志物（B错）用来诊断心肌梗死等疾病，患者无心肌梗死的临床表现如剧烈胸痛。心电图（C错）主要用来诊断心血管疾病，尤其的是对心律不齐有诊断意义。头颅CT（D错）主要用来诊断脑出血、脑梗死、脑部占位性病变，该患者虽然有脑部的神经精神症状，但是有呼吸困难，缺氧的前驱病史，故首选的诊断还是血气分析，了解体内是否存在缺氧，而不是头颅CT。